《中华人民共和国药品管理法》规定，药品生产或经营企业可以从不具有药品生产、经营资格的企业购进的是
A. 医疗机构配制的制剂
B. 中药
C. 中药饮片
D. 没有实施批准文号管理的中药材
E. 新发现和从国外引种的药材

正确答案：D。没有实施批准文号管理的中药材

解析：本题考查药品经营。《中华人民共和国药品管理法》规定，药品生产或经营企业可以从不具有药品生产、经营资格的企业购进的是没有实施批准文号管理的中药材（D对）。《中华人民共和国药品管理法》第五章药品经营第五十五条药品上市许可持有人、药品生产企业、药品经营企业和医疗机构应当从药品上市许可持有人或者具有药品生产、经营资格的企业购进药品；但是，购进未实施审批管理的中药材除外。